最符合肺小细胞癌组织学特点的是
A. 列兵样排列
B. 形成管状结构
C. 形成乳头状结构
D. 有角化珠
E. 有假菊形团结构

正确答案：E。有假菊形团结构

解析：肺小细胞癌镜下可见，癌细胞常呈圆形或卵圆形；也可呈梭形或燕麦形；或呈片状、条索状排列；有时也可围绕小血管形成假菊形团结构（E对）。癌细胞呈列兵样排列（A错）主要见于乳腺浸润性小叶癌（P304）。有角化珠（D错）主要见于高分化鳞状细胞癌（P97）。形成管状结构（B错）和乳头状结构（C错）均无较强特异性，可见于多种癌症组织内。